多巴胺药理作用不包括
A. 大剂量可使肾血管舒张
B. 对血管平滑肌β₂受体作用很弱
C. 直接激动心脏β₁受体
D. 激动血管平滑肌多巴胺受体
E. 间接促进去甲肾上腺素释放

正确答案：A。大剂量可使肾血管舒张

解析：多巴胺对肾脏有双重作用即低浓度时作用于多巴胺D₁受体，舒张肾血管，使肾血流量增加，肾小球的滤过增加，尿量增加，大剂量时兴奋肾血管的α受体，使肾血管明显收缩（A错，为本题正确答案）。多巴胺对心血管的作用与用药浓度有关，低浓度激动血管平滑肌多巴胺受体（D对），通过激活腺苷酸环化酶，使细胞内cAMP水平提高而致血管舒张，高浓度的多巴胺可作用于心脏β₁受体（C对），使心肌收缩力增强，心排血量增加，对心血管平滑肌β₂受体作用很弱（B对）。多巴胺是去甲肾上腺素生物合成的前体，可间接促进去甲肾上腺素的释放（E对）。